由下颌姿势位通过主动肌肉收缩上提下颌达到初始的（牙合）接触时，下颌的位置为
A. 息止颌位
B. 正中（牙合）位
C. 后退接触位
D. 铰链位
E. 肌接触位

正确答案：E。肌接触位

解析：由下颌姿势位通过主动肌肉收缩上提下颌达到初始的（牙合）接触时，下颌的位置为肌接触位（肌位）。掌握“下颌姿势位、三类颌位与前伸、侧方（牙合）颌位”知识点。